下列藏精汁的腑是
A. 脉
B. 脑
C. 胆
D. 胞宫
E. 骨

正确答案：C。胆

解析：胆是中空的囊状器官，内盛胆汁。古人认为胆汁是精纯、清净的精微物质，称为“精汁”，故胆有“中精之府”、“清净之府”或“中清之府”之称。（C对）。脉（A错）是血液运行的管道，血液在脉中循行于全身，所以脉又称为血府。脑（B错）居颅腔之中，为脑髓汇聚而成，故又称为“髓海”。胞宫（D错）又称女子胞、子宫，是主持月经和孕育胎儿的器官。骨（E错），指骨骼，是躯体的支架。骨骼的发育标志着人的形体的发育，由肾精充养，由肾气推动和调控。肾藏精，精生髓，髓居骨中以养骨，骨骼赖之以生长发育。